肾性急性肾衰竭最常见的原因是
A. 急性肾炎
B. 急性间质性肾炎
C. 急进型肾炎
D. 肾动脉栓塞
E. 急性肾小管损伤

正确答案：E。急性肾小管损伤

解析：肾性急性肾衰最常见的原因是以肾缺血和肾毒性物质导致肾小管损伤（E对）。急性肾炎（A错）、急性间质性肾炎（B错）、急进型肾炎（C错）、肾动脉栓塞（D错）都是肾性急性肾衰的病因，但不是最常见的病因。